干姜和细辛均有的功效是
A. 温中降逆
B. 温肺化饮
C. 温通血脉
D. 温脾止泻
E. 温肾散寒

正确答案：B。温肺化饮

解析：本题考查的是干姜与细辛的功效。干姜和细辛均有的功效是温肺化饮（B对）。干姜：【功效】温中，回阳，温肺化饮。细辛：【功效】祛风散寒，通窍，止痛，温肺化饮。丁香：【功效】温中降逆（A错），温肾助阳。桂枝：【功效】发汗解肌，温通经脉（C错），助阳化气。补骨脂：【功效】补肾壮阳，固精缩尿，温脾止泻（D错），纳气平喘。乌药：【功效】行气止痛，温肾散寒（E错）。